含罂粟壳不宜久服的中成药
A. 川贝止咳露
B. 强力枇杷露
C. 蛇胆陈皮胶囊
D. 止咳橘红丸
E. 二母宁嗽丸

正确答案：B。强力枇杷露

解析：本题考查强力枇杷露的药物组成。含罂粟壳不宜久服的中成药强力枇杷露（B对）。强力枇杷露（胶囊）【药物组成】枇杷叶、罂粟壳、百部、桑白皮、白前、枯梗、薄荷脑。【注意事项】因其含有毒的罂粟壳，故不可过量服用或久用。孕妇、哺乳期妇女及儿童慎用强力枇杷露，禁用强力枇杷胶囊。外感咳嗽及痰浊壅盛者慎用。服药期间，忌食辛辣厚味食物。川贝止咳露（A错）【药物组成】川贝母、枇杷叶、前胡、百部、桔梗、桑白皮、薄荷脑。蛇胆陈皮胶囊【临床应用】痰浊阻肺所致咳嗽。症见咳嗽痰多，质稠厚或黄，量多易咳，胸闷，脘痞，呕恶，苔腻或黄腻，脉滑。橘红丸（D错）（片、颗粒、胶囊）【药物组成】化橘红、浙贝母、陈皮、半夏（制）、茯苓、苦杏仁、紫苏子（炒）、桔梗、紫菀、款冬花、瓜蒌皮、石膏、地黄、麦冬、甘草。二母宁嗽丸（E错）【药物组成】知母、川贝母、石膏、栀子（炒）、黄芩、瓜蒌子（炒）、桑白皮（蜜炙）、茯苓、陈皮、枳实（麸炒）、五味子（蒸）、甘草（炙）。